患者女性，45岁，既往月经正常，近1年来经期延长10～15天，量多，此次停经50天，后有阴道出血20天，血红蛋白80g/L，盆腔检查（-），基础体温单相。为排除宫体癌应该进行下列何项辅助诊断
A. 腹腔镜检查并作活检
B. 分段诊刮并送病理
C. 子宫输卵管造影
D. CA125测定
E. 超声检查

正确答案：B。分段诊刮并送病理

解析：分段诊刮并组织病理报告一直是了解绝经前阴道不规则出血内膜状况的重要诊断手段，并且是判断绝经后出血原因的金指标。掌握“功能失调性子宫出血”知识点。